胸腔手术后可判断为内出血的情况是：从胸腔引流管每小时引流出的血液量超过
A. 150ml
B. 50ml
C. 100ml
D. 75ml
E. 125ml

正确答案：C。100ml

解析：术后出血可以发生在手术切口、空腔器官及体腔内。胸腔手术后从胸腔引流管内每小时引流出血液量持续超过100ml（C对），就提示有内出血。